以下哪一点不是社会舆论的特点
A. 传播具有广泛性
B. 对行为具有约束性
C. 具有一定的群众性
D. 具有自发性
E. 具有深刻性

正确答案：E。具有深刻性